一般来说，除化妆品重金属污染外，影响化妆品安全性的更常见的是
A. 有毒化学添加剂的含量
B. 化妆品本身含过量的限用物质
C. 化妆品包装材料的化学污染
D. 化妆品成分中的致敏物质
E. 微生物污染

正确答案：E。微生物污染

解析：本题考查除化妆品重金属污染外，影响化妆品安全性的更常见的污染。一般来说，除化妆品重金属污染外，影响化妆品安全性的更常见的是微生物污染（E对ABCD错）。被微生物污染的化妆品可出现变色、异味、发霉、酸败、膏体液化分层等，从而引起各类型的化妆品皮肤病。